男性，55岁，半年来感到右上后牙咬合不适，常有自发痛，检查：右上6牙体完整，腭侧牙龈退缩2～3mm，探诊可探入根分叉部位，X-ray示根分叉区阴影，近远中牙槽嵴顶水平吸收1/2，应该采用的治疗方案是
A. 根管治疗
B. 牙周手术
C. 洁治，根面平整
D. 调（牙合）
E. 以上都是

正确答案：E。以上都是

解析：本题考查Ⅲ度根分叉病变的治疗。Ⅲ度根分叉病变的根分叉区的牙槽骨被全部吸收，形成贯通性病变，探针能水平贯通分叉区，但它仍被牙周袋软组织覆盖而未直接暴露于口腔，X线片上可见完全的透射区，据此可判断该患者患牙属于Ⅲ度根分叉病变，对Ⅲ度病变可根据患牙的具体情况，行截根术、分根术或牙半切除术的牙周手术（B对）。在做截根术、分根术或牙半切除术前，均应先做完善的根管治疗（A对），还应进行调（牙合）（D对），以减轻患牙的咬合负担。根分叉病变治疗的具体目标之一为尽可能进行彻底的袋内清创，尤其注意清除根面的凹沟、根分叉顶部等处的菌斑牙石，因此应采用洁治术、刮治术、根面平整术（C对）对牙根表面的菌斑、牙石、病变牙骨质进行清理。（ABCD均对，故E为本题的正确答案）。